小脑下后动脉发自
A. 椎动脉
B. 基底动脉
C. 大脑后动脉
D. 脉络丛后动脉
E. 脉络丛前动脉

正确答案：A。椎动脉

解析：小脑下后动脉发自椎动脉（A对）。